治疗中度痤疮宜选用
A. 阿昔洛韦软膏
B. 维A酸乳膏
C. 氢化可的松软膏
D. 复方苯甲酸酊
E. 炉甘石洗剂

正确答案：B。维A酸乳膏

解析：本题考查痤疮治疗药。治疗中度痤疮宜选用维A酸乳膏（B对）。外用维A酸类药物可作为轻度座疮的单独一线用药，中度座疮的联合用药以及座疮维持治疗的首选。阿昔洛韦软膏（A错）可用于带状疱疹未破时的局部治疗。氢化可的松软膏（C错）用于过敏性皮炎、湿疹、神经性皮炎、脂溢性皮炎及瘙痒症等。复方苯甲酸酊（D错）用于治疗水疱型足癣。炉甘石洗剂（E错）用于急性瘙痒性皮肤病，如湿疹和痱子。